药品生产企业的行为规则包括
A. 生产药品所需的原料、辅料必须符合药用标准
B. 不符合国家药品标准的药品不得出厂
C. 必须从具有药品生产、经营资格的企业购进药品
D. 不得直接向医疗机构销售药品
E. 不得直接向药品零售企业销售药品

正确答案：A、B、C。生产药品所需的原料、辅料必须符合药用标准；不符合国家药品标准的药品不得出厂；必须从具有药品生产、经营资格的企业购进药品

解析：本题考查药品生产企业的行为规则。药品生产企业的行为规则包括：生产药品所需的原料、辅料必须符合药用标准（A对）；不符合国家药品标准的药品不得出厂（B对）；必须从具有药品生产、经营资格的企业购进药品（C对）。